某女怀孕后，非常想知道胎儿的性别，遂请好友某妇产科医师为其做胎儿性别签定。该医师碍于情面实施胎儿性别鉴定。根据《母婴保健法》的规定，当地卫生计生行政部门应对该医师作出的处理是
A. 处以罚款
B. 给予行政处分
C. 扣发年度奖金
D. 调离工作岗位
E. 离岗接受培训

正确答案：B。给予行政处分

解析：违反《母婴保健法》及其实施办法规定进行胎儿性别鉴定的，应由卫生行政部门给予警告，责令停止违法行为；对母婴保健机构直接负责的主管人员和其他直接责任人员，依法给予行政处分。该医师违反《母婴保健法》擅自实施胎儿性别鉴定，当地卫生计生行政部门应对该医师给予行政处分（B对）。